丙硫氧嘧啶可以特异性抑制的酶是
A. 单胺氧化酶
B. 胆碱酯酶
C. 甲状腺过氧化物酶
D. 黏肽代谢酶
E. 血管紧张素转化酶

正确答案：C。甲状腺过氧化物酶

解析：本题考查丙硫氧嘧啶的作用机制。丙硫氧嘧啶可以特异性抑制的酶是甲状腺过氧化物酶（C对）。硫脲类可通过抑制甲状腺过氧化物酶介导的酪氨酸碘化及偶联，从而抑制甲状腺激素的生物合成。去甲肾上腺素被细胞内的儿茶酚氧位甲基转移酶和单胺氧化酶（A错）所破坏。新斯的明的拟胆碱作用主要是由于可逆性地抑制胆碱酯酶（B错），使内源性和外源性ACh在体内堆积，表现出M样及N样效应。青霉素通过细菌的荚膜后，与胞浆膜上的青霉素结合蛋白相结合，抑制黏肽代谢酶（D错）（包括转肽酶、羧肽酶、内肽酶），除影响细胞壁合成外，还使菌体的生长受抑制，结果使自溶酶（黏肽水解酶）的抑制物分解，自溶酶解除抑制而活化，造成细胞膜的损伤使细菌溶解死亡。卡托普利主要抑制血管紧张素转化酶（E错），使AngⅡ生成减少，产生降压作用。